（115～117题共用题干）女，48岁，G2P2。月经周期紊乱伴潮热1年，阴道流血35天，伴头晕、乏力10天。妇科检查见宫颈轻度糜烂，无触血，子宫大小形态正常，双侧附件区未触及异常。超声检查示：子宫内膜厚0.8cm，无血流信号。对明确诊断最有价值的检查是
A. 性激素水平测定
B. 宫颈细胞学检查
C. HPV检测
D. 诊断性刮宫
E. 尿妊娠试验

正确答案：D。诊断性刮宫

解析：患者围绝经期女性（年龄＞35岁，且功血好发于绝经过渡期），月经周期紊乱伴潮热1年（内分泌紊乱表现），阴道流血35天，伴头晕、乏力10天（由阴道大量出血所导致的贫血症状）。妇科检查见宫颈轻度糜烂，无触血（初步排除宫颈癌变导致的阴道出血），子宫大小形态正常，双侧附件区未触及异常（排除子宫器质性病变）。超声检查示：子宫内膜厚0.8cm，无血流信号。该患者考虑功血可能性较大，应行诊断性刮宫（D对）（P347）以止血并明确子宫内膜病变。性激素水平测定（A错）（P347~349）用于检查有无排卵及黄体功能，也可用于排除其他内分泌疾病，但不可明确功血诊断。宫颈细胞学检查（B错）和HPV检测（C错）用于筛查CIN（子宫颈上皮内瘤变）及早期子宫颈癌（P303）。尿妊娠试验（E错）（P42）用于早孕的诊断。